在义齿修复前常需进行骨性隆突修整的部位中不包括
A. 上颌结节
B. 牙齿拔除后的骨尖
C. 磨牙后垫
D. 下颌双尖牙舌侧
E. 拔牙创部位

正确答案：C。磨牙后垫

解析：本题考查骨性隆突修整术的应用部位。在义齿修复前常需进行骨性隆突修整的部位中不包括磨牙后垫（C错，为本题正确答案）。磨牙后垫为位于下颌最后磨牙牙槽嵴远端的粘膜软垫，非骨性隆起。需进行修整的骨性隆突常发生于：①下颌磨牙和双尖牙舌侧（D对），一般双侧对称，也可为单侧，其大小不一，也称为下颌隆突；②腭中缝处，可呈分叶状，称为腭隆突；③上颌结节（A对），结节过度增生形成较大的骨性倒凹。此外拔牙创部位（E对）由于创伤过大造成牙槽嵴变形甚至骨折而又未能及时复位者，或拔牙后骨质吸收不均者，常形成骨尖或骨突，如牙齿拔除后的骨尖（B对），若一段时间后仍不消退且明显妨碍义齿摘戴时，也需进行骨性隆突修整。